根据《中华人民共和国药品管理法》，药品经营企业购进药品必须
A. 建立并执行检查验收制度
B. 验明药品合格证明
C. 验明药品相关标识
D. 验明中药材原产地的药检合格证明
E. 验明药品包装材料的审批标识

正确答案：A、B、C。建立并执行检查验收制度；验明药品合格证明；验明药品相关标识

解析：本题考查的是药品批发企业药品经营活动。根据《中华人民共和国药品管理法》，药品经营企业购进药品必须建立并执行检查验收制度（A对）、验明药品合格证明（B对）、验明药品相关标识（C对）。药品批发企业购进药品，应当建立并执行进货检查验收制度，索取、查验、留存《药品经营监督管理办法》规定的供货企业及其授权委托销售人员有关证件资料、销售凭证（保存至超过药品有效期1年，且不得少于5年），在验明药品合格证明和其他标识等证明药品合法性材料后方可购进、销售；不符合规定的，不得购进和销售。药品批发企业应当严格审核药品购货单位资质，按照其药品生产范围、经营范围或诊疗范围向其销售药品。